正面引导，表扬与批评，帮助与鼓励，属于医学道德教育中的哪种方法
A. 案例讨论，以理导人
B. 个别引导、以法育人
C. 多加开导，以理服人
D. 积极疏导、以情动人
E. 舆论扬抑，以境育人

正确答案：D。积极疏导、以情动人

解析：正面引导，表扬与批评，帮助与鼓励，属于医学道德教育中的积极疏导、以情动人的方法。掌握“医学道德教育”知识点。